下列哪种结构是操纵子所没有的
A. 启动子
B. 调控基因
C. 结构基因
D. 操纵基因
E. 5′帽子结构

正确答案：E。5′帽子结构